下列属于性传播疾病最危险的传染源的是
A. 症状典型的患者
B. 症状不典型的患者
C. 吸毒者
D. 供血者
E. 性乱者

正确答案：B。症状不典型的患者

解析：本题考查性传播疾病最危险的传染源。性传播疾病最危险的传染源是症状不典型的患者（B对ACDE错），许多STDs感染者没有或仅有轻微的临床症状，常不能主动就医，使大量STDs感染者不能被及时发现、诊断和治疗，成为最危险的STDs传染源。